患儿，女，7岁。结喉处红肿绕喉，根脚处散漫，肿势延及颈部两侧，按之中软，有应指感，治疗应首选
A. 内服普济消毒饮
B. 外治以菊花汁调制玉露散箍围束毒
C. 半流质饮食
D. 切开排脓
E. 药线引流

正确答案：D。切开排脓

解析：患者为儿童，结喉处红、肿、热、痛，根脚步散漫且已成脓，来势迅猛，为锁喉痈成脓期之诊断要点。即已成脓应及时切开排脓，以达到排出脓液以消炎解毒、减少局部疼痛肿胀，预防窒息发生等的目的（D对）。内服普济消毒饮适用于初起痰热蕴结证（A错）。以菊花汁调制玉露散箍围束毒适用于肿势散漫不聚者，现病情较危急，不宜首选箍围束毒（B错）。半流质饮食为成脓期的饮食调护，非治疗方法（C错）。药线引流为切开排脓后为使余脓排尽的后续疗法（E错）。